调凹式就位道是指
A. 两侧基牙长轴延长线的角平分线为就位道
B. 通过模型的倾斜把倒凹集中在一方，与（牙合）力方向一致的就位道
C. 通过模型的倾斜把倒凹集中在一方，与（牙合）力方向不一致的就位道
D. 就位道与基牙长轴相一致
E. 就位道与（牙合）力方向一致

正确答案：C。通过模型的倾斜把倒凹集中在一方，与（牙合）力方向不一致的就位道

解析：本题考查调凹式就位道。调凹式就位道是指用调凹法取得的就位道，调凹就是使倒凹适当的集中在某些基牙或基牙的某个侧面上；义齿采用斜向就位，可利用制锁作用即就位道与功能状态中义齿实际的脱位方向不一致而造成的约束状态来增强义齿固位，故就位道与（牙合）力方向不一致（C对BE错）。而均凹式就位道是指两侧基牙长轴延长线的角平分线（A错）。